未成熟B细胞表达的抗体是
A. IgM
B. IgM、IgD
C. IgG
D. IgA
E. IgE

正确答案：A。IgM

解析：本题考查各类抗体的特性与功能。未成熟B细胞表达的抗体是IgM（A对）。1.IgG（C错）于出生后3个月开始合成，3～5岁接近成人水平，是血清和胞外液中含量最高的Ig。IgG半寿期约20～23天，是再次免疫应答产生的主要抗体，其亲和力高，在体内分布广泛，是机体抗感染的“主力军”。2.IgM占血清免疫球蛋白总量的5%～10%，血清浓度约1mg/ml。单体IgM以膜结合型（mIgM）表达于B细胞表面，构成B细胞抗原受体（BCR），只表达mIgM是未成熟B细胞的标志。IgM是个体发育过程中最早合成和分泌的抗体，在胚胎发育晚期的胎儿即能产生IgM，故脐带血某些病毒特异性IgM水平升高提示胎儿有宫内感染。IgM也是初次体液免疫应答中最早出现的抗体，是机体抗感染的“先头部队”；血清中检出病原体特异性IgM，提示新近发生感染，可用于感染的早期诊断。3.SIgA（D错）合成和分泌的部位在肠道、呼吸道乳腺、唾液腺和泪腺，因此主要存在于胃肠道和支气管分泌液、初乳唾液和泪液中。SIgA是外分泌液中的主要抗体类别，参与黏膜局部免疫，通过与相应病原微生物结合，阻止病原体黏附到细胞表面，从而在局部抗感染中发挥重要作用，是机体抗感染的“边防军”。SIgA在黏膜表面也有中和毒素的作用。新生儿易患呼吸道、胃肠道感染可能与IgA合成不足有关。婴儿可从母亲初乳中获得SIgA，是重要的自然被动免疫。4.IgD分为两型：血清型IgD的生物学功能尚不清楚；膜结合型IgD（mIgD）是B细胞分化发育成熟的标志，未成熟B细胞仅表达mIgM，成熟B细胞可同时表达mIgM和mIgD，称为初始B细胞；B细胞活化后其表面的mIgD逐渐消失。5.IgE（E错）的重要特征在于它是一类亲细胞抗体，其CH2和CH3结构域可与肥大细胞、嗜碱性粒细胞上的高亲和力FcεRI结合，当结合再次进入机体的抗原后可引起I型超敏反应。此外，IgE可能与机体抗寄生虫免疫有关。